开放性骨折
A. 骨折处皮肤粘膜完整，骨折端不与外界相通
B. 骨折处软组织破裂，骨折端与外界相通
C. 骨折部碎成3块以上
D. 发生于肌腱附着部位的骨折
E. 骨折有移位、畸形

正确答案：B。骨折处软组织破裂，骨折端与外界相通

解析：开放性骨折指骨折处皮肤及筋膜或骨膜破裂，骨折端与外界相通（B对），骨折处的创口可由刀伤、枪伤由外向内形成，亦可由骨折端刺破皮肤或黏膜从内向外所致。如伴膀胱或尿道破裂的耻骨骨折。骨折处皮肤粘膜完整，骨折端不与外界相通（A错）指闭合性骨折。骨折部碎成3块以上（C错）指粉碎性骨折。发生于肌腱附着部位的骨折（D错）指撕脱性骨折，具体表述为由于肌肉强烈收缩，造成与肌腱相连的骨的突起和粗隆部的骨质分离。骨折有移位、畸形（E错）指不稳定骨折，具体表述为在生理外力作用下，骨折端易发生移位的骨折。